不促进胰岛素释放，不加重肥胖的降糖药为
A. 甲福明
B. 甲苯磺丁脲
C. 格列本脲
D. 格列吡嗪
E. 氯磺丙脲

正确答案：A。甲福明

解析：甲福明即二甲双胍，降血糖的作用机制：①促进脂肪组织摄取葡萄糖；②抑制胰高血糖释放；③抑制肠壁细胞摄取葡萄糖及糖原异生。与胰岛素作用不同，即本品无促使脂肪合成的作用，对正常人血糖无明显影响。故此药主要用于轻症糖尿病患者，尤其适用于肥胖及单用饮食控制无效者。掌握“胰岛素、磺酰脲类及双胍类药”知识点。